斜切面韧皮部有树脂状分泌物呈红棕色至黑棕色，与木质部相间排列呈3～8个偏心性半圆形环的药材是
A. 木通
B. 钩藤
C. 大血藤
D. 鸡血藤
E. 桑枝

正确答案：D。鸡血藤

解析：本题考查的是药物的性状鉴别。斜切面韧皮部有树脂状分泌物呈红棕色至黑棕色，与木质部相间排列呈3～8个偏心性半圆形环的药材是鸡血藤（D对）。鸡血藤：【性状鉴别】药材呈椭圆形、长矩圆形或不规则的斜切片。栓皮灰棕色，有的可见灰白色斑块，栓皮脱落处显红棕色。质坚硬。切面木部红棕色或棕色，导管孔多数；韧皮部有树脂状分泌物呈红棕色至黑棕色，与木部相间排列呈数个同心性椭圆形环或偏心性半圆形环；髓部偏向一侧。气微，味涩。木通（A错）：【性状鉴别】药材呈圆柱形，常稍扭曲。表面灰棕色至灰褐色，外皮粗糙而有许多不规则的裂纹或纵沟纹，具突起的皮孔。节部膨大或不明显，具侧枝断痕。体轻，质坚实，不易折断，断面不整齐，皮部较厚，黄棕色，可见淡黄色颗粒状小点，木部黄白色，射线呈放射状排列，髓小或有时中空，黄白色或黄棕色。气微，味微苦而涩。钩藤（B错）：【性状鉴别】药材为带单钩或双钩的茎枝小段。茎枝呈圆柱形或类方柱形。表面红棕色至紫红色者，具细纵纹，光滑无毛；黄绿色至灰褐色者有的可见白色点状皮孔，被黄褐色柔毛。多数枝节上对生两个向下弯曲的钩（不育花序梗），或仅一侧有钩，另一侧为突起的疤痕；钩略扁或稍圆，先端细尖，基部较阔；钩基部的枝上可见叶柄脱落后的窝点状痕迹和环状托叶痕。质坚韧，断面黄棕色，皮部纤维性，髓部黄白色或中空。气微，味淡。大血藤（C错）：【性状鉴别】药材呈圆柱形，略弯曲。表面灰棕色，粗糙，外皮常呈鳞片状剥落，剥落处显暗红棕色，有的可见膨大的节及略凹陷的枝痕或叶痕。质硬，断面皮部红棕色，有数处向内嵌入木部，木部黄白色，有多数细孔状导管，射线呈放射状排列。气微，味微涩。桑枝（E错）的性状鉴别，2022年考试指南未明确说明。